疾病谱和死因谱的改变指的是
A. 烈性传染病的增加
B. 慢性非传染性疾病的下降
C. 烈性传染病的下降与慢性非传染性疾病的增加
D. 老年性疾病的下降
E. 新型传染病的下降

正确答案：C。烈性传染病的下降与慢性非传染性疾病的增加